当传染病暴发流行时，可以采取停工停业停课等措施的是
A. 医疗机构
B. 疾病预防控制机构
C. 各级人民政府卫生行政部门
D. 卫生监督机构
E. 各级人民政府

正确答案：E。各级人民政府

解析：当传染病暴发、流行时，各级人民政府（E对）应当立即组织力量，按照预防、控制预案进行防治，切断传染病的传播途径，必要时，报经上一级人民政府决定，可以采取下列紧急措施并予以公告：①限制或者停止集市、影剧院演出或者其他人群聚集的活动；②停工、停业、停课；③封闭或者封存被传染病病原体污染的公共饮用水源、食品以及相关物品；④控制或者扑杀染疫野生动物、家畜家禽；⑤封闭可能造成传染病扩散的场所。